结构中含有六元内酯环的血脂调节药物是
A. 阿托伐他汀
B. 吉非贝齐
C. 非诺贝特
D. 洛伐他汀
E. 氯贝丁酯

正确答案：D。洛伐他汀

解析：本题考查他汀类药物。洛伐他汀（D对）含六元内酯环，是天然的HMG-CoA还原酶抑制剂。阿托伐他汀（A错）、吉非贝齐（B错）、非诺贝特（C错）、氯贝丁酯（E错）分子内无六元内酯。